善于通利二便的药有
A. 芦荟
B. 郁李仁
C. 巴豆霜
D. 牵牛子
E. 火麻仁

正确答案：B、D。郁李仁；牵牛子

解析：本题考查郁李仁和牵牛子的性能特点。善于通利二便的药有郁李仁（B对）、牵牛子（D对）。郁李仁【性能特点】本品辛散苦降，甘平质润，入脾经与大肠、小肠经。既润肠通便，又利水消肿，还行肠中滞气。治肠燥便秘，兼气滞者尤佳；治水肿胀满及脚气浮肿，兼二便不利者最宜。牵牛子【性能特点】本品苦寒降泄，有毒力猛，入肺、肾、大肠经，既善通利二便，显泻下逐水与消痰涤饮之效，为治水肿、痰饮、便秘之猛药；又善消食积、驱杀肠道寄生虫，为治食积、虫积之良药。少则动大便，多则下水饮，尤宜水肿、痰饮兼二便不利或积滞内停者。功似遂、戟、芫，虽泻下逐水，使水邪从二便出，但药力与毒性均稍缓。传统认为，皮有收涩之性，故泻下逐水宜去皮用。芦荟（A错）【性能特点】本品苦寒清泄，沉降下行，入大肠经与肝经。既泻热通肠，导热毒与湿热外出，又杀肠道寄生虫，促进糟粕与虫体排出，还凉肝而定惊，为治热秘、肝火及小儿热惊、热疳之良药。外用能清火、杀皮肤寄生虫而止痒。泻热通肠与大黄相似，长于凉肝定惊，兼除肠胃湿热而杀虫疗疳，尤以肝经实火、肝郁化火或惊抽兼便秘者用之为佳，小儿疳积兼湿热者尤宜。巴豆【性能特点】本品辛热泻散，大毒峻猛。内服入胃经与大肠经，善峻下寒积、逐水退肿；入肺经，善祛痰利咽而治白喉，有斩关夺门之功。外用腐蚀力强而善蚀肉腐疮，喷撒于咽部而能除白喉伪膜，敷于恶疮而能溃脓、去腐肉。生用力猛，虽峻下寒积，但因毒大，故临床几乎不用；熟用毒稍缓而药力强，临床少用；去油制霜即巴豆霜（C错），药力较缓，毒性大减，故临床常用。火麻仁（E错）【性能特点】本品甘平油润，香美可口，入脾、大肠经。善润燥滑肠兼补虚，体虚肠燥者最宜。